在临床医学研究中必须尊重受试者的知情同意权，下面做法中错误的是
A. 必需获得受试者的知情同意
B. 无行为能力者需获得代理同意
C. 获得同意前需要用受试者能够理解的语言向受试者提供基本的信息
D. 禁止用欺骗的手法获得受试者同意
E. 可以利诱受试者，让他同意

正确答案：E。可以利诱受试者，让他同意

解析：知情同意是人体试验受试者自主权的体现。因此，医学科研人员要给准备参加人体试验的受试者提供足够、正确的有关信息，并且是他们能够充分理解和有责任回答他们的质疑。在此基础上，由受试者决定是否参加人体试验，且这种决定是完全自由的；对缺乏或丧失自主行为能力者应征得家属或监护人的同意。同时也应该说明，即使已参加人体实验的受试者，在任何时候都可以撤销同意，并且不应因此遭到报复。掌握“涉及人和动物的医学实验伦理”知识点。